原发性疱疹性口炎的发病过程在临床上可分为
A. 前驱期、水疱期、糜烂期、愈合期
B. 前驱期、水疱期、糜烂期、静止期
C. 充血期、水疱期、糜烂期、愈合期
D. 前驱期、水疱期、静止期、愈合期
E. 前驱期、充血水肿期、糜烂期、愈合期

正确答案：A。前驱期、水疱期、糜烂期、愈合期

解析：原发性疱疹性口炎：①前驱期②水疱期③糜烂期④愈合期。掌握“口腔单纯疱疹”知识点。